肝素抗凝血作用的主要机制是
A. 阻碍凝血因子Ⅱ、Ⅶ、Ⅸ、Ⅹ的合成
B. 抑制血小板聚集
C. 增强ATⅢ对凝血因子的灭活作用
D. 降低血中钙离子浓度
E. 促进纤维蛋白溶解

正确答案：C。增强ATⅢ对凝血因子的灭活作用

解析：肝素的生物活性主要取决于血浆蛋白酶抑制剂抗凝血酶，抗凝血酶含有精氨酸-丝氨酸肽活性部位，与许多凝血因子及纤维蛋白溶酶发生缓慢的化学结合，形成稳定的复合物从而抑制些凝血因子，发挥抗凝作用。肝素的抗凝机制是由抗凝血酶介导，从而间接抑制凝血酶，带负电荷的肝素可与正电荷的抗凝血酶赖氨酸残基形成可逆性复合物，使抗凝血酶构型发生变化，充分暴露其活性中心，抗凝血酶的精氨酸残基迅速与酶活性中心结合，从而加速抗凝血酶对凝血因子的灭活（C对）。阻碍凝血因子Ⅱ、Ⅶ、Ⅸ、X的合成（A错）（P266）为华法林的抗凝作用机制。抑制血小板聚集（B错）（P270）为抗血小板药阿司匹林的作用机制。降低血中钙离子浓度（D错）为枸橼酸钠抗凝的主要机制。促进纤维蛋白溶解（E错）（P267）为溶栓药物的作用机制。